舌乳头炎的发病因素与下列哪一项无关
A. 维生素缺乏
B. 真菌感染
C. 残根残冠刺激
D. 吸烟
E. 不良修复体

正确答案：D。吸烟

解析：引起舌乳头炎的全身因素有维生素缺乏、贫血、真菌感染等。局部因素有残根、残冠、牙石等刺激和两侧后牙锐利牙尖的摩擦。叶状乳头在人类已退化，呈皱褶状位于舌后部的舌缘两侧，因接近咽部，故咽部的炎症可波及。掌握“地图舌、沟纹舌及舌乳头炎”知识点。